人参固本丸主治
A. 热入心包导致的神昏谵语
B. 肝火扰心导致的烦躁不眠
C. 气血不足导致的心悸失眠
D. 热郁胸膈导致的烦躁不眠
E. 阴虚气弱导致的心悸气短

正确答案：E。阴虚气弱导致的心悸气短

解析：本题考查的是人参固本丸的主治。人参固本丸主治阴虚气弱导致的心悸气短（E对）。人参固本丸：【主治】阴虚气弱，虚劳咳嗽，心悸气短，骨蒸潮热，腰酸耳鸣，遗精盗汗，大便干燥。安宫牛黄丸：【主治】热病，邪入心包，高热惊厥，神昏谵语（A错）；中风昏迷及脑炎、脑膜炎、中毒性脑病、脑出血、败血症见上述证候者。人参归脾丸：【主治】心脾两虚、气血不足所致的心悸、怔忡、失眠（C错）健忘、食少体倦、面色萎黄，以及脾不统血所致的便血、崩漏、带下。主治为肝火扰心导致的烦躁不眠（B错）或热郁胸膈导致的烦躁不眠（D错）的中成药，2022年考试指南未明确说明。